进行队列研究时比较的方法有
A. 暴露组与非暴露组比较
B. 队列内部按照暴露程度比较
C. 与全人群的率比较
D. A＋C
E. A＋B＋C

正确答案：E。A＋B＋C

解析：本题考查队列研究对照的选择。在队列研究中，对照的选择可以是：①暴露组与非暴露组比较；②队列内部按照暴露程度比较；③与全人群的率比较（E对ABCD错）；④多重对照。